过度思虑可导致的是
A. 气上
B. 气下
C. 气结
D. 气消
E. 气乱

正确答案：C。气结

解析：该题考查七情内伤致病对脏腑气机的影响。过怒导致肝气疏泄太过，气机上逆，甚至血随气逆，并走于上的病机变化，即怒则气上（A错）。过度恐惧伤肾，致使肾气失固，气陷于下的病机变化，即恐则气下（B错）。过度思虑伤脾，导致脾气郁滞，运化失职的病机变化，即思则气结（C对）。过度悲忧伤肺，导致肺失宣降及肺气耗伤的病机变化，即悲则气消（D错）。猝然受惊伤心，导致心神不定，气机逆乱的病机变化，即惊则气乱（E错）。